下列有关主动脉胸部行径的说法,正确的是
A. 起于脊柱右侧第1胸椎高度
B. 左侧有奇静脉伴行
C. 前方有胸导管伴行
D. 全程下行于椎体正前方
E. 约在第10胸椎水平进入腹腔

正确答案：E。约在第10胸椎水平进入腹腔

解析：胸主动脉起于脊柱左侧（D错）第4胸椎（A错）高度。约在第10胸椎水平穿膈的主动脉裂孔进入腹腔（E对）。主动脉后方有胸导管伴行（C错）。